治疗滴虫性阴道炎宜选用
A. 雌激素
B. 孕激素
C. 雄激素
D. 甲硝唑
E. 克霉唑

正确答案：D。甲硝唑

解析：滴虫阴道炎是由阴道毛滴虫引起的常见阴道炎症，可同时有尿道、尿道旁腺、前庭大腺滴虫感染。甲硝唑是治疗滴虫最有效的药物且不影响阴道正常菌群生长，故治疗滴虫性阴道炎宜选用甲硝唑（D对）。克霉唑（P250）（E错）为抗真菌药物，可用于外阴阴道念珠菌病的治疗。雌激素（A错）、孕激素（B错）、雄激素（C错）与滴虫阴道炎发病无关，不用于其治疗。